下列关于鼓膜的描述，正确的是
A. 为一透明膜
B. 位于外耳道底
C. 呈垂直位
D. 附着在蜗窗上
E. 具有感受声波的作用

正确答案：E。具有感受声波的作用

解析：鼓膜位于外耳道与鼓室之间（B错），为椭圆形半透明薄膜（A错），直径约1cm, 与外耳道底形成约45°~ 50° 的倾斜角。小儿的鼓膜更为倾斜，几乎呈水平位（C错）。鼓膜边缘的大部分附着于颞骨上（D错）。声波经外耳道传至鼓膜，引起鼓膜振动，可知鼓膜可以感受声波（E对）。